某女，40岁。月经非时而下，量多如崩，色淡质稀，神疲体倦，面色萎黄；舌质淡，舌体胖苔薄白，脉弱。应选用的方剂是
A. 固冲汤加减
B. 逍遥散加减
C. 调肝汤加减
D. 内补丸加减
E. 固阴煎加减

正确答案：A。固冲汤加减

解析：本题考查的是崩漏的辨证论治。月经非时而下，量多如崩，色淡质稀，神疲体倦，面色萎黄；舌质淡，舌体胖苔薄白，脉弱。应选用的方剂是固冲汤加减（A对）。逍遥散加减（B错）为绝经前后诸证肝郁肾虚证的方剂应用。经前后诸证肝郁肾虚证：【症状】经断前后，阵发性烘热汗出，腰膝酸软，烦躁易怒，情绪异常，头晕耳鸣，乳房胀痛，月经紊乱，或胸闷善太息。舌淡红或偏暗，苔薄白，脉弦细。【方剂应用】基础方剂为：一贯煎（北沙参、麦冬、当归、生地黄、枸杞子、川楝子）合逍遥散（柴胡、当归、白芍、白术、茯苓、甘草、薄荷、煨姜）加减。调肝汤加减（C错）为痛经肝肾亏虚证的方剂应用。痛经肝肾亏虚证：【症状】经期或经后小腹绵绵作痛，经行量少，色暗淡，质稀薄；腰膝酸软，头晕耳鸣；舌淡红，苔薄，脉沉细。【方剂应用】基础方剂为调肝汤（当归、白芍、山茱萸、巴戟天、阿胶、山药、甘草）加减。内补丸加减（D错）为带下过多肾阳亏虚证的方剂应用。带下过多肾阳亏虚证：【症状】带下量多，绵绵不断，质清稀如水；腰痛如折，畏寒肢冷，小腹冷感，面色晦暗，小便清长，或夜尿多，大便溏薄。舌质淡，苔白润，脉沉迟。【方剂应用】基础方剂为内补丸（鹿茸、肉苁蓉、菟丝子、沙苑子、肉桂、制附子、黄芪、桑螵蛸、蒺藜、紫菀、茯神）加减。固阴煎加减（E错）为月经先期肾气虚证的方剂应用。月经先期肾气虚证：【症状】月经周期提前，经量或多或少，色淡暗，质清稀；腰膝酸软，头晕耳鸣，面色晦暗或面有暗斑。舌淡暗，苔白，脉沉细。【方剂应用】基础方剂为固阴煎（人参、熟地、山药、山茱萸、远志、炙甘草、五味子、菟丝子）或归肾丸（熟地、菟丝子、山药、枸杞、茯苓、杜仲、山茱萸、当归）加减。